急性尿潴留病因中，属于机械性梗阻的是
A. 腰麻和肛管直肠术后
B. 外伤性高位截瘫
C. 使用药物阿托品普鲁苯辛后
D. 腹泻或长期使用利尿剂
E. 尿道结石

正确答案：E。尿道结石

解析：尿潴留的病因可分为机械性梗阻和动力性梗阻。其中机械性梗阻最多见，包括良性前列腺增生、前列腺肿瘤、膀胱颈挛缩、各种原因引起的尿道狭窄、肿瘤和尿道结石（E对）等。动力性梗阻包括脊髓（B错）或马尾损伤、直肠肛管手术损伤副交感神经分支、腰麻（A错）术后等。此外阿托品（C错）、山莨菪碱等药物可松弛平滑肌，导致排尿困难引起尿潴留。腹泻或长期使用利尿剂（D错）一般不会引起急性尿潴留。